双氯芬酸钠的化学名是
A. 2-[（2，6-二氯苯基）氨基]-α-甲基苯乙酸钠
B. 2-[（2，5-二氯苯基）氨基]-苯乙酸钠
C. 2-[（2，6-二氯苯基）氨基]-苯乙酸钠
D. 2-[（2，5-二氯苯基）氨基]-α-甲基苯乙酸钠
E. 2-[（2，6-二氯苯基）氨基]-苯丙酸钠

正确答案：C。2-[（2，6-二氯苯基）氨基]-苯乙酸钠